患者，男，74岁。胸痛剧烈，如割如刺，胸闷如窒，气短痰多，心悸不宁，腹胀纳呆，恶心呕吐，舌质紫黯，舌苔浊腻，脉滑。诊断为急性前壁心肌梗死，其证型是
A. 气滞血瘀证
B. 寒凝心脉证
C. 心阳欲脱证
D. 阳虚水泛证
E. 痰瘀互结证

正确答案：E。痰瘀互结证

解析：痰浊盘踞，胸阳失展，故胸痛剧烈，如割如刺，胸闷如窒，气短痰多；心失濡养故见心悸不宁；痰浊困脾，脾失健运故见腹胀纳呆，恶心呕吐；舌质紫黯，舌苔浊腻，脉滑，均为痰瘀互结之侯，故可诊断为急性前壁心肌梗死痰瘀互结证（E对）。气滞血瘀证（A错）特点为胸中痛甚，胸闷气促，烦躁易怒，心悸不宁，脘腹胀满，唇甲青紫。寒凝心脉证（B错）特点为心痛如绞，胸痛彻背，胸闷憋气，形寒畏冷，四肢不温，冷汗自出。心阳欲脱证（C错）的特点为胸闷憋气，胸痛频发，四肢厥逆，大汗淋漓，面色苍白，口唇发绀，手足清至节，虚烦不安，甚至神志淡漠，或突然昏厥。阳虚水泛证（D错）特点为胸痛胸闷，喘促心悸，气短乏力，畏寒肢冷，腰部、下肢浮肿，面色苍白，唇甲淡白或青紫，舌淡胖或紫暗。